关于生物标志，不正确的是
A. 生物标志可用于测量生物有效剂量
B. 生物标志可用于内剂量的测量
C. 生物标志可用于测量早期生物效应
D. 生物标志可用于宿主易感性的评价
E. 生物标志不包括细胞结构和功能改变的指标

正确答案：E。生物标志不包括细胞结构和功能改变的指标

解析：本题考查生物标志。生物标志是生物体内发生的与发病机制有关联的关键事件的指示物，是机体由于接触各种环境因素所引起机体器官、细胞、亚细胞的生化、生理、免疫和遗传等任何可测定的改变（E错，为本题正确答案）。生物标志可用于测量生物有效剂量（A对）、内剂量（B对）、早期生物效应（C对）以及宿主易感性的评价（D对）。